釉质晶体的宽约
A. 100～140nm
B. 60～70nm
C. 5～15nm
D. 20～30nm
E. 160～1000nm

正确答案：B。60～70nm

解析：本题考查釉质晶体的宽度。釉质晶体的宽约60～70nm（B对）。釉质中的晶体是全身各种矿化组织晶体中最大的，宽约60～70nm，厚约25～30nm。